炭疽杆菌治疗首选
A. 青霉素
B. 红霉素
C. 阿奇霉素
D. 庆大霉素
E. 链霉素

正确答案：A。青霉素